某社区年均人口为9万，年内共死亡150人，其中60岁以上死亡100人；在全部死亡者中，因肿瘤死亡人数为50人，该社区年内共出生100人。该社区人口出生率为
A. 0.56‰
B. 1.66‰
C. 0.33‰
D. 1.11‰
E. 0.3333

正确答案：D。1.11‰

解析：本题考查出生率的概念。出生率又称为粗出生率，是指一定时期内（通常指1年内）平均每千人中出生人数的比率。根据题意可计算出出生率为100/90000＝1.11‰（D对ABCE错）。